两样本均数比较的t检验，其目的是检验
A. 两样本均数是否相等
B. 两样本所属的总体均数是否相等
C. 两样本所属总体的均数相差有多大
D. 两样本所属总体的均数为多大
E. 两样本均数相差有多大

正确答案：B。两样本所属的总体均数是否相等

解析：两样本均数比较的t检验，其目的是检验两样本所属的总体均数是否相等（B对），它是用两样本均数来推断其所属的总体均数，其检验假设即为两总体均数相等。